Cmax是指
A. 药物消除速率常数
B. 药物消除半衰期
C. 药物在体内的达峰时间
D. 药物在体内的峰浓度
E. 药物在体内的平均滞留时间

正确答案：D。药物在体内的峰浓度

解析：本题考查药动学参数。单室模型血管外途径给药，血药浓度-时间关系为单峰曲线，峰值为峰浓度（D对）Cmax，达峰时间（C错）为tmax；药物消除速率常数（A错）为k；药物消除半衰期（B错）为t1/2；药物在体内的平均滞留时间（E错）为MRT。